药物排泄的主要部位是
A. 肝脏
B. 胆
C. 汗腺
D. 肾脏
E. 肺

正确答案：D。肾脏

解析：本题考查药物排泄。药物排泄的主要部位是肾脏（D对）。